患者平素眩晕，耳鸣。突然发生口舌歪斜，舌强语謇。半身不遂，但其神志清楚，舌红，脉弦滑。治疗应首选
A. 大秦艽汤
B. 镇肝熄风汤
C. 龙胆泻肝汤
D. 地黄饮子
E. 苏合香丸

正确答案：B。镇肝熄风汤

解析：肾阴素亏，肝阴不足，肝阳上亢，故平素眩晕，耳鸣；阴不制阳，相火内动，虚风内生，故突然发生口舌歪斜，舌强语謇，半身不遂；神志清楚为风中经络，证属阴虚风动；治宜滋阴潜阳，用镇肝熄风汤（B对）。大秦艽汤（A错）用于外风。龙胆泻肝汤（C错）用于肝经湿热。地黄饮子（D错）用于下元虚衰、痰浊上犯的喑痱证。苏合香丸（E错）用于寒闭证。